城市热岛引起
A. 郊区大气污染向城市扩散
B. 城区大气污染向郊区扩散
C. 白天城市大气污染向郊区扩散
D. 夜间城市大气污染向郊区扩散
E. 温室效应

正确答案：A。郊区大气污染向城市扩散

解析：本题考查城市热岛效应。城市热岛效应是指城市气温高于郊区气温的现象，可引起郊区大气污染向城市扩散（A对BCDE错）。